麦粒肿为
A. 结膜发炎
B. 泪痰发炎
C. 脸板腺发炎
D. 睫毛腺发炎
E. 泪腺发炎

正确答案：D。睫毛腺发炎

解析：麦粒肿是睫毛毛囊或睫毛腺的急性炎症，即睫毛腺发炎（D对）。